以下关于牙周组织中密质骨特点的说法正确的一项为
A. 牙周膜发生炎症变化时，密质骨不消失
B. 密质骨骨板的排列组织学上与牙槽窝内壁垂直
C. 密质骨的骨板排列方向与穿通纤维平行
D. 密质骨骨板在近牙周膜侧由哈弗系统组成
E. 密质骨骨板近骨髓侧由哈弗系统组成

正确答案：E。密质骨骨板近骨髓侧由哈弗系统组成

解析：本题考查牙槽骨。以下关于牙周组织中密质骨特点的说法正确的一项为密质骨骨板近骨髓侧由哈弗系统组成（E对）。硬骨板，即固有牙槽骨，是检查牙周组织的重要标志，牙周膜发生炎症和外伤性变化时，硬骨板首先消失（A错）。组织学上硬骨板近牙周膜表面排列方向与牙槽窝内壁平行（B错），与穿通纤维垂直（C错），而在近骨髓侧骨板由哈弗系统构成（D错）。